由先存的良性成釉细胞瘤发展而来的成釉细胞癌是
A. 成釉细胞癌-原发型
B. 成釉细胞癌-继发型（去分化）
C. 成釉细胞瘤-滤泡型
D. 成釉细胞瘤-丛状型
E. 成釉细胞瘤-棘皮瘤型

正确答案：B。成釉细胞癌-继发型（去分化）

解析：成釉细胞癌-继发型（去分化）是由先存的良性成釉细胞瘤发展而来的成釉细胞癌。掌握“成釉细胞癌”知识点。